某机场通道两侧需要安装护栏，以保证旅客安全。工程技术人员查阅了有关资料，按照最大百分位数的人体重心高度确定了护栏的高度，从工效学的角度讲，这种设计属于
A. 最大值设计
B. 最小值设计
C. 安全度设计
D. 单限值设计
E. 中位数设计

正确答案：D。单限值设计